视觉传导通路中的第三级神经元是
A. 视网膜双极细胞
B. 内侧膝状体
C. 视网膜节细胞
D. 外侧膝状体神经元细胞
E. 无

正确答案：D。外侧膝状体神经元细胞

解析：视觉传导通路由三级神经元组成：眼球视网膜神经部外层的视锥细胞和视杆细胞为光感受器细胞，中层的双极细胞为第1级神经元（A错），内层的节细胞为第2级神经元（C错），第3级神经元胞体在外侧膝状体内（D对）。